促使轴突末梢释放神经递质的离子流是
A. K⁺外流
B. Na⁺内流
C. Ca²⁺内流
D. Cl⁻内流
E. H⁺外流

正确答案：C。Ca²⁺内流